可引起“双硫仑样”反应，服药期间禁止饮酒的抗菌药物有
A. 头孢哌酮
B. 甲硝唑
C. 呋喃妥因
D. 磷霉素
E. 头孢他啶

正确答案：A、B。头孢哌酮；甲硝唑

解析：本题考查抗菌药物。可引起“双硫仑样”反应，服药期间禁止饮酒的抗菌药物有头孢哌酮（A对）、甲硝唑（B对）。头孢他啶（E错）化学结构中没有甲硫四氮唑侧链和甲硫三嗪侧链，不会发生双硫仑样反应。呋喃妥因（C错）和磷霉素（D错）不会引起“双硫仑样”反应。